属于高度恶性淋巴瘤的是
A. 小无裂细胞型
B. 滤泡性小裂细胞型
C. 弥漫性小裂细胞型
D. 滤泡性大细胞型
E. 弥漫性大细胞型

正确答案：A。小无裂细胞型

解析：小无裂细胞型（未分化型）（A对）是B细胞来源的高度恶性的淋巴瘤。弥漫性小裂细胞型（C错）淋巴瘤属于低度恶性的淋巴瘤。滤泡性淋巴瘤是B细胞来源的惰性淋巴瘤，在病程进展过程中约30%可转化为弥漫性大B细胞淋巴瘤，恶性程度较高（BD错）。弥漫性大细胞型淋巴瘤（弥漫性大B细胞淋巴瘤）（E错）是B细胞来源的恶性程度较高的肿瘤。